“低剂量刺激，高剂量抑制”指的是
A. 毒效应谱
B. 毒物兴奋效应
C. 毒物损害作用
D. 毒物促进作用

正确答案：B。毒物兴奋效应

解析：本题考查毒物兴奋效应。“低剂量刺激，高剂量抑制”指的是毒物兴奋效应（B对ACD错）。